大肠的募穴是
A. 中脘
B. 天枢
C. 巨阙
D. 膻中
E. 中极

正确答案：B。天枢

解析：天枢为大肠的募穴，定位在脐中旁开2寸，属足阳明胃经（B对）。中脘穴为胃的募穴（A错）。巨阙为心的募穴（C错）。膻中为心包的募穴（D错）。中极为膀胱经的募穴（E错）。记忆：分类记忆法，三焦、脾、肝、肾，对应四门，石门、章门、期门、京门；胃、膀胱、肺、心包，对应四中，中脘、中级、中府、膻中；心-巨阙，巨大的心；大肠-天枢，小肠-关元，大天，小关；胆日月。